人乳和牛乳相比较下列哪项是错误的
A. 牛乳蛋白质含量较人乳高
B. 牛乳所含乳糖较人乳为多
C. 人乳含免疫因子较多
D. 牛乳吸收率仅为人乳的1/5
E. 牛乳其成分并不适合婴儿

正确答案：B。牛乳所含乳糖较人乳为多

解析：牛乳所含乳糖较人乳为少，故喂食时最好添加5%～8%的糖，且主要为甲型乳糖，有利于大肠杆菌的生长。掌握“婴儿喂养方法”知识点。